影响骨折愈合的最重要因素是
A. 软组织损伤
B. 神经损伤
C. 静脉血栓
D. 断端血供
E. 健康状况

正确答案：D。断端血供

解析：影响骨折的因素包括全身因素和局部因素，全身因素包括年龄、健康状况等。局部因素包括骨折的类型、骨折部位的血液供应、软组织损伤程度、软组织嵌入和感染。其中，影响骨折愈合的关键是断端血供（D对），若断端血供不良或断端无血供，则直接导致骨折的愈合不良或不愈合。而软组织损伤（A错）、健康状况（E错）主要影响骨折愈合的速度。神经损伤（B错）和静脉血栓（C错）不是影响骨折愈合的因素。